疑有宫颈管病变时，应采取的措施是
A. 清宫术
B. 取适量内膜活检
C. 测基础体温
D. 经行24-48小时刮宫
E. 分段诊刮

正确答案：E。分段诊刮

解析：诊刮术是刮取子宫内膜做病理检查，以明确诊断以指导治疗。对于疑有颈管病变的，需进行分段诊刮。分段诊刮，是诊断宫腔疾病采用的重要操作之一，其目的是刮取腔内容物（子宫内膜和其他组织）做病理检查（E对）。